属于M胆碱受体阻断剂的平喘药是
A. 茶碱
B. 沙美特罗
C. 噻托溴铵
D. 孟鲁司特
E. 布地奈德

正确答案：C。噻托溴铵

解析：本题考查平喘药的分类。属于M胆碱受体阻断剂的平喘药是噻托溴铵（C对）。茶碱（A错）为黄嘌呤类平喘药。沙美特罗（B错）为长效β₂受体激动剂。孟鲁司特（D错）为白三烯受体阻断剂。布地奈德（E错）为吸入型糖皮质激素。